肝硬化特征性病理表现是
A. 肝细胞坏死
B. 假小叶形成
C. 炎细胞浸润
D. 肝细胞水肿变性
E. 肝细胞脂肪变性

正确答案：B。假小叶形成

解析：假小叶（B对）是由纤维间隔包绕再生结节或将残留肝小叶重新分割形成，是肝硬化特征性病理表现。肝细胞坏死（A错）、炎细胞浸润（C错）、肝细胞水肿变性（D错）可见于肝炎、肝硬化及多种肝脏疾病中，不具有典型代表性。